杂豆类制作成粉条、凉皮等过程中大部分被去除的营养素是
A. 膳食纤维
B. 矿物质
C. 维生素
D. 蛋白质
E. 脂肪

正确答案：D。蛋白质

解析：本题考查杂豆类制作成粉条、凉皮等过程中大部分被去除的营养素。由于杂豆类淀粉含量较高，可以制作成粉条、粉皮、凉皮等，这些产品大部分蛋白质（D对ABCE错）被去除，故其营养成分以碳水化合物为主。